某女，51岁。脘腹痞闷，肢体困重，口淡不渴，面色淡黄而虚浮，舌淡苔白腻，脉濡缓。其面色表现多因
A. 脾胃虚寒
B. 脾虚湿盛
C. 阳虚水泛
D. 气血俱虚
E. 痰湿内盛

正确答案：B。脾虚湿盛

解析：面色黄而虚浮者，称为黄胖，属脾虚湿盛。因脾失健运，水湿内停，泛溢肌肤所致（B对）。面色㿠白者，多属脾胃虚寒证（A错）。㿠白虚浮者，多属阳虚水泛（C错）。面色淡白无华，多属气血俱虚（D错）。面色暗黄而虚浮，多属痰湿内盛（E错）。